具有缓释作用，可显著减轻药物毒性或刺激性的丸剂有
A. 蜡丸
B. 水蜜丸
C. 大蜜丸
D. 浓缩丸
E. 糊丸

正确答案：A、E。蜡丸；糊丸

解析：本题考查的是丸剂的特点。具有缓释作用，可显著减轻药物毒性或刺激性的丸剂有蜡丸（A对）、糊丸（E对）。糊丸的特点：①溶散迟缓，释药缓慢，“取其迟化”可延长药效。②减少药物对胃肠道的刺激性。含毒性或刺激性饮片以及需延缓药效的方药，可制成糊丸。蜡丸的特点：①“蜡丸取其难化而旋旋取效或毒药不伤脾胃”，即蜡丸在体内不溶散，缓缓持久释放药物而延长药效，与现代骨架型缓释、控释制剂相似。②毒性或刺激性强的药物，制成蜡丸可减轻毒性和刺激性。③其释药速率的控制难度大，目前蜡丸品种少。蜜丸（C错）的特点：①性质柔润，作用缓和持久。②有补益和矫味作用，由于蜂蜜含有大量的糖、有机酸及维生素等丰富的营养成分，具有滋补作用；味甜能矫味；同时蜂蜜具有镇咳、缓下、润燥、解毒的作用。浓缩丸（D错）的特点：①浓缩丸中部分或全部饮片经提取浓缩（抑或纯化）处理，具有体积和服用剂量小，易于吸收，服用、携带及贮存方便等优点。②浓缩过程受热时间较长，因此应注意某些成分可能会受影响。